下列哪种疫苗不属于目前我国儿童基础免疫程序
A. 卡介苗
B. 甲型肝炎疫苗
C. 脊髓灰质炎活疫苗
D. 百白破混合制剂
E. 乙型肝炎疫苗

正确答案：B。甲型肝炎疫苗

解析：本题考查我国儿童基础免疫程序。卡介苗（A对）、脊髓灰质炎活疫苗（C对）、百白破混合制剂（D对）、乙型肝炎疫苗（E对）均属于目前我国儿童基础免疫程序。甲型肝炎疫苗（B错，为本题正确答案）不属于目前我国儿童基础免疫程序。